血液循环
A. 大循环始于右心室
B. 小循环始于左心室
C. 大循环内流动的是动脉血
D. 小循环内流动的是动脉血
E. 小循环的主要功能是将静脉血转为动脉血

正确答案：E。小循环的主要功能是将静脉血转为动脉血

解析：小循环即肺循环的主要功能是将静脉血转为动脉血（E对）。